以上哪种药品可以使脱矿的牙体硬组织再次矿化
A. 再矿化液
B. 硝酸银溶液
C. 75%氟化钠甘油糊剂
D. 8%氟化亚锡溶液
E. 1.5%含氟凝胶

正确答案：A。再矿化液

解析：再矿化治疗是采用人工方法是脱矿釉质或牙骨质再次矿化，使其恢复硬度，终止或消除早期龋损。掌握“龋病的治疗原则与非手术治疗方法”知识点。